建筑工人不慎坠楼，腰剧痛，双下肢感觉运动障碍，大小便功能障碍。现场搬运的正确方法是
A. 平托法
B. 单人搂抱法
C. 双人搂抱法
D. 侧卧搬运法
E. 背驮法

正确答案：A。平托法

解析：患者坠楼后，腰剧痛（提示可能有胸腰段脊柱骨折），双下肢感觉运动障碍、大小便功能障碍（提示有脊髓损伤），结合患者病史和临床表现，该患者最可能的诊断为胸腰段脊柱骨折合并脊髓损伤。对于已有或怀疑有脊髓损伤病人，也必须按照脊柱骨折急救方法处理，故该患者现场搬运的正确方法是平托法（A对）。可避免搬运过程中对患者造成二次损伤，保持脊柱的稳定性。搂抱法（BC错）、侧卧搬运法（D错）、背驼法（E错）等动作十分危险，因为这些方法会增加患者脊柱的弯曲，可将碎骨片向后挤入椎管内，加重脊髓损伤。